能引起硅沉着病的粉尘是
A. 石棉尘
B. 矽尘
C. 铁矿尘
D. 铝尘
E. 水泥尘

正确答案：B。矽尘